mRNA碱基插入或缺失可造成框移突变由于密码的
A. 摆动性
B. 通用性
C. 连续性
D. 简并性
E. 特异性

正确答案：C。连续性